含有氯苯那敏成分的中成药是
A. 维C银翘片
B. 散痰宁糖浆
C. 消渴丸
D. 痢特敏片
E. 清咳散

正确答案：A。维C银翘片

解析：本题考查含有化学成分的中成药。维C银翘片（A对）含西药马来酸氯苯那敏，对乙酰氨基酚，维生素C。散痰宁糖浆（B错）含有西药盐酸麻黄碱、氯化铵。消渴丸（C错）含西药格列本脲。痢特敏片（D错）含西药甲氧苄啶。清咳散（E错）含西药盐酸溴己新。